小儿能独坐是在
A. 四个月
B. 六个月
C. 七个月
D. 八个月
E. 九个月

正确答案：B。六个月

解析：本题考查运动的发育。小儿能独坐是在六个月（B对）。平衡与大运动：（1）抬头：新生儿俯卧时能抬头1～2秒；3个月时抬头较稳；4个月时抬头很稳。（2）坐：6个月时能双手向前撑住独坐；8个月时能坐稳。（3）翻身：7个月时能有意识地从仰卧位翻身至俯卧位，然后从俯卧位翻至仰卧位。（4）爬：应从3～4个月时开始训练，8～9个月可用双上肢向前爬。（5）站、走跳：11个月时可独自站立片刻；15个月可独自走稳；24个月时可双足并跳；30个月时会独足跳。